下列有关细菌超抗原可引发金葡菌食物中毒，说法正确的是
A. 恶心
B. 腹绞痛
C. 剧烈呕吐
D. 由金葡菌肠毒素引起
E. 以上说法均正确

正确答案：E。以上说法均正确

解析：细菌超抗原可引发金葡菌食物中毒和毒性休克综合征。金葡菌食物中毒由金葡菌肠毒素引起，人可在接触大量的金葡菌肠毒素后2～8小时发病，出现恶心，剧烈呕吐，腹绞痛，可伴有腹泻。该病有自限性，可在发病后的24～48小时内自愈。掌握“抗原基本概念、分类、超抗原及佐剂”知识点。